含亚铁盐地下水抽出地面后呈现
A. 棕色或棕黄色
B. 绿色或黄绿色
C. 黄褐色
D. 黑色
E. 蓝色

正确答案：A。棕色或棕黄色

解析：本题考查地下水的浑浊度。浑浊现象常用来判断水是否遭受污染的一个表观特征，地表水的浑浊是水中含泥沙、黏土、有机物等造成的，河水因流经地区的土壤和地质条件不同，浑浊度可能有较大差别，不同季节的河水，其浑浊程度也可有较大差别。地下水一般较清澈，若水中含有二价铁盐，与空气接触后就会产生氢氧化铁，使水呈棕黄色（A对BCDE错）浑浊状态。